急性乳腺炎常见的原因为
A. 病毒感染
B. 内分泌失调
C. 不良生活习惯
D. 饮食结构不合理
E. 乳汁淤积

正确答案：E。乳汁淤积

解析：急性乳腺炎的发病原因主要有乳汁淤积（E对）和细菌入侵两个方面。